男性，42岁，自幼起咳嗽、咳痰、喘息，多为受凉后发作，静滴“青霉素”可缓解，10-20岁无发作。20岁后又有1次大发作，发作时大汗淋漓、全身发紫、端坐不能平卧，肺部可闻及哮鸣音，静脉推注“氨茶碱地塞米松”可完全缓解。自后反复出现夜间轻微喘息，每周发作3次以上，不能入睡，PEF变异率为35%。查体：双肺听诊未闻及干湿啰音，心率89次/分。为了提高疗效，减少复发，教育患者需掌握
A. 正确使用气雾剂的方法
B. 哮喘患者不发作可不用药
C. 抗感染药治疗可根治哮喘
D. 哮喘患者不发作不能使用激素
E. 哮喘者需长期使用β₂受体激动剂

正确答案：A。正确使用气雾剂的方法

解析：患者反复出现夜间轻微喘息，每周发作3次以上，不能入睡，PEF变异率为35%，可诊断为支气管哮喘，为了提高疗效，减少复发，教育患者需掌握正确的吸入技术（A对）、峰流速仪的使用方法等。非急性发作期哮喘控制水平的分级为部分控制，哮喘患者须通过此分级水平来决定不发作时能否不用药以及激素（BD错）。哮喘不是细菌感染类疾病，所以抗感染药治疗不能根治哮喘（C错）。哮喘者是否需要长期使用β₂受体激动剂应通过综合各情况及非急性发作期哮喘控制水平的分级来决定（E错）。